复方磺胺甲恶唑片的含量测定方法为
A. 亚硝酸钠滴定法
B. 硝酸银滴定法
C. 紫外分光光度法
D. 荧光分析法
E. 高效液相色谱法

正确答案：E。高效液相色谱法